药典规定取用量为“约”若干时，系指取用量不得超过规定量的
A. ±0.1%
B. ±1%
C. ±5%
D. ±10%
E. ±2%

正确答案：D。±10%

解析：本题考查中国药典的凡例。药典规定取用量为“约”若干时，系指取用量不得超过规定量的±10%（D对）。取用量为“约”若干时，系指取用量不得超过规定量的±10%（CE错）。“精密称量”指称取重量应准确至所取重量的千分之一（A错）。“称定”指称取重量应准确至所取重量的百分之一（B错）。